制作金属烤瓷修复体时，若烤瓷的热膨胀系数大于金属的热膨胀系数，在烧结冷却过程中，可产生下述哪种不良后果
A. 瓷层剥脱
B. 瓷层龟裂、破碎
C. 瓷层出现气泡
D. 瓷层颜色变灰暗
E. 金属变形

正确答案：B。瓷层龟裂、破碎

解析：本题考查基底金属与烤瓷的线胀系数的匹配。制作金属烤瓷修复体时，若烤瓷的热膨胀系数大于金属的热膨胀系数，在烧结冷却过程中，可产生瓷层龟裂、破碎（B对）。烤瓷的热膨胀系数大于金属的热膨胀系数，在烧结冷却过程中，会产生瓷层龟裂、破碎的不良后果，这是因为金属收缩小于烤瓷，烤瓷受到金属基底的制约而产生拉应力，由于烤瓷的拉伸强度很低，烤瓷在拉应力作用下容易产生裂纹。瓷层剥脱（A错）是由于烤瓷的热膨胀系数小于金属的热膨胀系数，此时金属收缩远大于烤瓷，烤瓷受到较大的压应力会剥脱。瓷层出现气泡（C错）是由于烧结过程中升温过高、过快；瓷层颜色变灰暗（D错）可能是瓷粉在烧结过程中被污染或者遮色瓷不足，使金属基底的颜色透出来；金属变形（E错）可能是金属基底蜡型在包埋、铸造、开盒、打磨过程中操作失误造成，这些都与线胀系数无关。